可使高血压患者血压升高的药物是
A. 速感宁胶囊
B. 银翘解毒片
C. 复方酚咖伪麻胶囊
D. 抗感宁胶囊
E. 复方田七胃痛胶囊

正确答案：C。复方酚咖伪麻胶囊

解析：本题考查药物的不良反应。可使高血压患者血压升高的药物是复方酚咖伪麻胶囊（C对）。速感宁胶囊（A错）不良反应有困倦、嗜睡、口渴、虚弱感。银翘解毒片（B错）用于风热感冒。复方田七胃痛胶囊（E错）前列腺肥大、青光眼患者禁用。